某男性患者，30岁，有吸毒史（注射）。近半年来体重减轻，发烧，口腔反复发生真菌感染。首先考虑为AIDS。AIDS的传播途径有
A. 性行为
B. 血液传播
C. 母婴传播
D. A+B选项
E. A+B+C选项

正确答案：E。A+B+C选项

解析：本题考查艾滋病的传播途径。某男性患者，30岁，有吸毒史（注射）。近半年来体重减轻，发烧，口腔反复发生真菌感染。首先考虑为AIDS。AIDS的传播途径有性行为（A对）、血液传播（B对）、母婴传播（C对）等途径。（ABC均对，故E为本题的正确答案）。